我国古代医患关系的特点是
A. 直接性密切性从众性
B. 直接性、稳定性、从众性
C. 稳定性、密切性、直接性
D. 稳定性、从众性、主动性
E. 直接性、稳定性、主动性

正确答案：E。直接性、稳定性、主动性

解析：我国古代医患关系的特点是直接性、稳定性、整体性、主动性、继承性（E对）。